献血大王刘某，在过去的7年间，献血总量己达5600ml。快满50周岁的刘某告诉记者，如果身体一直保持健康状态，他满55周岁以前，还可争取无偿献血
A. 7次
B. 8次
C. 9次
D. 10次
E. 11次

正确答案：D。10次

解析：国家提倡18周岁至55周岁的健康公民自愿献血，快满50周岁的献血大王刘某还可以献5年，献血间隔不得少于6个月，每年最多献2次，因此如果身体一直保持健康状态，他满55周岁以前，还可争取无偿献血10次（D对）。